舌的神经支配
A. 舌神经和舌咽神经分布于味蕾
B. 舌神经分布于舌前2/3黏膜
C. 舌神经支配舌肌运动
D. 舌咽神经管理舌前2/3味觉
E. 面神经和舌咽神经分布于舌黏膜

正确答案：B。舌神经分布于舌前2/3黏膜

解析：舌神经分布于舌前2/3的黏膜（A错B对）。舌咽神经分布于舌后1/3的黏膜和味蕾（D错）。舌下神经支配舌肌运动（C错）。面神经分布于舌前2/3的味蕾（E错）。